我国药品监督管理部门的主要药事管理职能涉及
A. 药品管理
B. 药事组织管理
C. 医疗保险用药管理
D. 药品价格管理
E. 药品、药事组织、执业药师管理

正确答案：E。药品、药事组织、执业药师管理